亚硫酸氢钠常用作偏酸性中药注射液的
A. 潜溶剂
B. 抛射剂
C. 渗透压调节剂
D. 助悬剂
E. 抗氧剂

正确答案：E。抗氧剂

解析：本题考查的是注射液的附加剂。亚硫酸氢钠常用作偏酸性中药注射液的抗氧剂（E对）。注射剂的抗氧剂：抗氧剂是一类易被氧化的还原剂。常用的抗氧剂有亚硫酸钠、亚硫酸氢钠和焦亚硫酸钠等，一般浓度为0.1%～0.2%。其中亚硫酸钠常用于偏碱性药液，亚硫酸氢钠和焦亚硫酸钠常用于偏酸性药液。潜溶剂（A错）为气雾剂的附加剂。气雾剂的潜溶剂有乙醇、丙二醇等。抛射剂（B错）为气雾剂的组成部分。气雾剂的抛射剂：为适宜的低沸点液化气体。抛射剂是喷射药物的动力，有时兼作药物的溶剂和稀释剂。根据气雾剂所需压力，可将两种成几种抛射剂以适宜比例混合使用。①氢氟烷烃类。②二甲醚。③碳氢化合物。④惰性气体。注射剂的渗透压调节剂（C错）：常用的调节渗透压的附加剂有氯化钠、葡萄糖等。注射剂的助悬剂（D错）：为了制备混悬液型注射液的需要，在保证安全有效的前提下，可考虑加入适量的助悬剂。甘油可用作助悬剂。